不直接被胞内第二信使调节的蛋白激酶是
A. PKA
B. PKC
C. PKG
D. TPK
E. Ca²⁺-CaM激酶

正确答案：D。TPK